地图舌患者可能有的症状是
A. 自发痛
B. 口干
C. 冷热疼
D. 烧灼、刺激痛
E. 阵发性疼痛

正确答案：D。烧灼、刺激痛

解析：本题考查地图舌的临床表现。地图舌患者可能有的症状是烧灼、刺激痛（D对）。地图舌是一种浅表性非感染性的舌部炎症，因其表现类似地图标示的蜿蜒国界，故名地图舌。患者一般无疼痛等不良感觉，如自发痛（A错）、冷热疼（C错）、阵发性疼痛（E错）；但合并真菌、细菌感染或伴沟纹舌继发感染时，再食用刺激性食物、乙醇饮料、接触某些口腔科材料，则会有烧灼样疼痛或钝痛。口干（B错）出现在灼口综合征等疾病的口腔表现中。